下列各项，属瘀血内阻临床表现的是
A. 面色黧黑
B. 面黑干焦
C. 面黑浅淡
D. 眼周发黑
E. 耳轮焦黑

正确答案：A。面色黧黑

解析：本题考查瘀血内阻的临床表现，属于理解记忆内容。在望诊方面，久瘀可见面色黧黑（A对），肌肤甲错，唇甲青紫，舌质紫暗，或有瘀点、瘀斑，舌下经脉曲张等征象。面黑干焦者，多属肾阴虚（B错）。病人面黑暗淡或黧黑者，多属肾阳虚（C错）。眼眶周围发黑者，多属肾虚水饮或寒湿带下（D错）。耳轮焦黑，多属肾精亏虚，精不上容（E错）。